关于药物溶解度问题的正确表述有
A. 溶剂的极性对药物溶解度的影响很小
B. 在溶液中有相同离子时，由于同离子效应，药物溶解度会降低
C. 非极性药物溶解于非极性溶剂中形成的是诱导偶极-诱导偶极作用
D. 稳定型的药物溶解度大于亚稳定型的药物溶解度
E. 当摩尔溶解热为负值时，溶解度随温度升高而加大

正确答案：B、C。在溶液中有相同离子时，由于同离子效应，药物溶解度会降低；非极性药物溶解于非极性溶剂中形成的是诱导偶极-诱导偶极作用